男，21岁。患急性白血病半个月，化疗期间出现皮肤瘀斑。血常规：Hb70g/L，RBC2.4×10¹²/L，WBC2.6×10⁹/L，Plt10×10⁹/L，给予输注机采血小板1个治疗量，输注完毕后，患者出现严重吸气性呼吸困难伴喘鸣，查体：T36.8℃，P115次/分，R25次，BP85/50mmHg，该患者最可能发生的输血不良反应是
A. 严重过敏反应
B. 急性溶血性输血反应
C. 输血相关低血压
D. 输血相关移植物抗宿主病
E. 输血相关循环超负荷

正确答案：A。严重过敏反应

解析：患者男，21岁。患急性白血病半个月，化疗期间出现皮肤瘀斑。绐予输注机采血小板1个治疗量，输注完毕后，患者出现严重吸气性呼吸困难伴喘鸣。因过敏反应：多发生在输血数分钟后，也可在输血中或输血后发生。严重者可出现支气管痉挛，血管神经性水肿，会厌水肿，表现为咳嗽，哮喘，呼吸困难以及腹痛，腹泻，甚至过敏性休克乃至昏迷，死亡。所以该患者最可能发生的输血不良反应是严重过敏反应（A对）急性溶血性输血反应多发生在输入十几毫升血型不合的血后，（B错）严重时会出现血压下降。（C错）输血相关移植物抗宿主病是有免疫活性的淋巴细胞输入有严重免疫缺陷的受血者体内以后，输入的淋巴细胞成为移植物并增殖，对受血者的组织起反应。（D错）输血相关循环超负荷多见于大量输血后，可出现低体温，碱中毒，暂时性低氧血钙，高钾血症。（E错）